男，76岁。一年来日常活动时即感胸闷，3天前突发夜间阵发性呼吸困难，伴咳粉红泡沫痰。查体：BP100/70mmHg，心尖搏动呈抬举样，胸骨右缘第二肋间可闻及4/6级收缩期喷射样杂音，向颈部传导，双肺可闻及散在细湿啰音。对明确诊断最有帮助的检查是：
A. 心电图
B. 胸部CT
C. 胸部X线片
D. 超声心动图
E. 心电图运动负荷试验

正确答案：D。超声心动图

解析：患者老年男性，有活动时胸闷症状，3天前突发夜间阵发性呼吸困难，伴咳粉红泡沫痰（急性肺水肿特征性痰液），双肺可闻及散在细湿啰音；查体：心尖搏动呈抬举样，胸骨右缘第二肋间（主动脉瓣区）可闻及4/6级收缩期喷射样杂音，向颈部传导（主动脉瓣狭窄典型杂音），综合患者的病史、临床表现和体格检查，考虑诊断为主动脉瓣狭窄伴急性肺水肿。对确诊主动脉瓣狭窄最有帮助的检查是超声心动图（D对）。超声心动图可直接观察瓣膜的形态、结构和功能，目前多用于瓣膜疾病的确诊。心电图（A错）主要用于心律失常的诊断，主动脉瓣狭窄患者并无特异性的心电图改变。胸部CT（B错）主要用于胸部疾病的诊断，如肺癌和胸腔积液等。胸部X线片（C错）为影像学检查，主动脉瓣狭窄患者一般心影不大，形状略有变化，并无特征性改变。心电图运动负荷试验（P220）（E错）主要用于冠心病的诊断，且明显心力衰竭或急性疾病者禁作运动试验。